功能攻毒杀虫、祛风止痛的药是
A. 藜芦
B. 雄黄
C. 露蜂房
D. 硫黄
E. 土荆皮

正确答案：C。露蜂房

解析：本题考查的是露蜂房的功效。功能攻毒杀虫、祛风止痛的药是露蜂房（C对）。露蜂房：【功效】攻毒杀虫，祛风止痛。藜芦（A错）：【功效】涌吐风痰，杀虫疗癣。雄黄（B错）：【功效】解毒，杀虫，燥湿祛痰，截疟定惊。硫黄（D错）：【功效】外用解毒杀虫止痒，内服补火助阳通便。土荆皮（E错）：【功效】杀虫，疗癣，止痒。